天门冬的功效为
A. 生津
B. 润肠
C. 二者均是
D. 二者均不是

正确答案：C。二者均是

解析：本题考查的是天冬的性能特点。天门冬的功效为生津与润肠（C对）。天门冬为天冬的别名。天冬：【性能特点】本品甘润补，苦泄降，寒能清，入肺、肾经，为清滋滑润之品。既润肺止咳、清肺降火，又滋肾养阴、生津（A错）止渴，还清润肠（B错）燥而通便，善治阴虚火旺诸证。【功效】滋阴降火，清肺润燥，润肠通便。